流感流行的最重要传染源是
A. 潜伏期感染者
B. 典型患者
C. 恢复期患者
D. 隐性感染者
E. 受感染的动物

正确答案：B。典型患者

解析：本题考查流感流行的最重要传染源。流感流行的传染源主要是典型患者（B对AC错），其次为隐性感染者（D错），受感染的动物（E错）也可能是一种传染源。